化妆品本身具有多种化学物质，其中有的具有致癌作用，有的属毒性物质。如冷烫液中的硫代甘醇类，染发剂中的对苯二胺，这些物质均属于
A. 致癌性化合物
B. 致突变性化合物
C. 微毒类化合物
D. 高毒类化合物
E. 无毒类化合物

正确答案：D。高毒类化合物